下列有益健康的身体活动的推荐量，错误的搭配是
A. 5～17岁儿童青少年应每天累计至少60分钟中等到高强度体力活动
B. 5～17岁儿童青少年每天累计大于60分钟的体力活动可以提供更多的健康效益
C. 18～64岁成年人每周至少150分钟中等强度有氧体力活动
D. 18～64岁成年人有氧活动应该每次至少持续10分钟
E. 老年人应每周完成至少120分钟中等强度有氧体力活动

正确答案：E。老年人应每周完成至少120分钟中等强度有氧体力活动

解析：有益健康的身体活动推荐量：①5～17岁年龄组：应每天累计至少60分钟中等到高强度体力活动，大于60分钟的体力活动可以提供更多的健康效益。②18～64岁年龄组：每周至少150分钟中等强度有氧体力活动，或每周至少75分钟高强度有氧体力活动，或中等和高强度两种活动相当量的组合，有氧活动应该每次至少持续10分钟。③65岁及以上年龄组：应每周完成至少150分钟中等强度有氧体力活动。掌握“身体活动促进”知识点。